正向突变试验基因位点是
A. 6﹣GT位点，TK位点，HGPRT位点
B. TK位点，HGPRT位点，OUA位点
C. HGPRT位点，6﹣GT位点，OUA位点
D. OUA位点，TK位点，6﹣GT位点
E. OUA位点，TK位点，5﹣Bru位点

正确答案：B。TK位点，HGPRT位点，OUA位点